《处方药与非处方药流通管理暂行规定》要求，销售处方药和甲类非处方药的零售药店
A. 必须具有《药品经营许可证》
B. 不得以开架自选方式销售处方药
C. 必须开架销售非处方药
D. 不得采用有奖销售、附赠药品或礼品等销售方式售药
E. 必须配备坐堂医师，指导合理用药

正确答案：A、B、D。必须具有《药品经营许可证》；不得以开架自选方式销售处方药；不得采用有奖销售、附赠药品或礼品等销售方式售药

解析：本题考查处方药与甲类非处方药销售管理。《处方药与非处方药流通管理暂行规定》第九条规定，销售处方药和甲类非处方药的零售药店必须具有《药品经营许可证》（A对）。第十一条规定，处方药不得采用开架自选销售方式（B对）。第十四条规定，处方药、非处方药不得采用有奖销售、附赠药品或礼品（D对）销售等销售方式，暂不允许采用网上销售方式。